上述哪项指标反映左心室的前负荷
A. 平均动脉压
B. 中心静脉压
C. 肺动脉压
D. 右心室舒张末期压力
E. 左心室舒张末期压力

正确答案：E。左心室舒张末期压力

解析：左心室的前负荷是指心脏收缩前左心室所承受的负荷，相当于左心室舒张末期压力（E对）。